下列关于输尿管的说法正确的是
A. 全长约20～30cm
B. 可分为三段即腹段、盆段、壁内段
C. 上端起自肾盂，下端终于膀胱
D. 全长有三处生理狭窄，常是结石滞留部位
E. 上述说法全部正确

正确答案：E。上述说法全部正确

解析：输尿管全长20~30cm（A对），上端起自肾盂，下端终于膀胱（C对）；可分为三段即腹段、盆段、壁内段（B对），有三处生理性狭窄，常是结石滞留部位（D对，故E为本题正确答案）。